中年男性，六年糖尿病史。发热就诊，体温39.5℃，心率110次每分。无黄疸，腹水。白细胞20.4×10⁹/L，中性粒细胞率0.85。肝内4×4.5×6.5cm脓肿，与胸膜腔相通。超声引导下穿刺，培养革兰氏阴性杆菌，吲哚试验和乳糖试验阳性。考虑可能的感染是哪种？
A. 大肠埃希菌
B. 痢疾杆菌
C. 志贺氏菌
D. 沙门菌属
E. 脆弱拟杆菌

正确答案：A。大肠埃希菌

解析：该患者中年男性，超声引导下穿刺，培养革兰氏阴性杆菌，吲哚试验和乳糖试验阳性等结果，考虑可能的感染大肠埃希菌，因为大肠埃希菌能发酵葡萄糖和乳糖，吲哚试验阳性（A对）。